根据《城镇职工基本区疗保险定点零售药店管理暂行规定》，对为城镇职工基本医疗保险参保人员提供处方外配服务的零售药店实行
A. 轮换制
B. 定点制
C. 终身制
D. 承包制
E. 责任制

正确答案：B。定点制

解析：本题考查的是《城镇职工基本区疗保险定点零售药店管理暂行规定》。根据《城镇职工基本区疗保险定点零售药店管理暂行规定》，对为城镇职工基本医疗保险参保人员提供处方外配服务的零售药店实行定点制（B对）。处方外配是指参保人员持定点医疗机构处方，在定点零售药店购药的行为。